属于选择性5-HT₄受体激动剂的是
A. 法莫替丁
B. 多潘立酮
C. 氯苯那敏
D. 奥美拉唑
E. 莫沙必利

正确答案：E。莫沙必利

解析：本题考查选择性5－HT₄受体激动剂。莫沙必利（E对）为选择性5－HT₄受体激动剂，能促进乙酰胆碱的释放，刺激胃肠道而发挥促动力作用，改善功能性消化不良等胃肠道症状；法莫替丁（A错）为抑酸剂，可阻断组胺H₂受体，抑制胃酸分泌；多潘立酮（B错）为外周多巴胺受体阻断剂，直接阻断胃肠道多巴胺D₂受体；氯苯那敏（C错）为烃烷基胺类抗组胺药，具有中等程度的镇静作用和抗胆碱作用；奥美拉唑（D错）为第一代质子泵抑制剂，对基础胃酸的分泌，以及组胺、食物、五肽胃泌素及刺激迷走神经等引起的胃酸分泌，均产生强大而持久的抑制作用。